患者，男，67岁，慢性咳喘病史20余年，现因哮喘急性发作就诊，首选药物是
A. 氨茶碱片
B. 二羟丙茶碱片
C. 沙丁胺醇气雾剂
D. 异丙托溴铵气雾剂
E. 布地奈德混悬液

正确答案：C。沙丁胺醇气雾剂

解析：本题考查支气管哮喘的药物治疗。患者，男，67岁，慢性咳喘病史20余年，现因哮喘急性发作就诊，首选药物是沙丁胺醇（C对）。短效β₂受体激动剂常用药物有沙丁胺醇和特布他林等。可供吸入的SABA剂型包括气雾剂、溶液等。这类药物能够迅速缓解支气管痉挛，通常在数分钟内起效，疗效可维持数小时，是缓解轻至中度哮喘急性症状的首选药物，也可用于预防运动性哮喘。氨茶碱片（A错）和二羟丙茶碱片（B错）属于茶碱类药物，异丙托溴铵气雾剂（D错）属于短效抗胆碱药物，布地奈德混悬液（E错）属于糖皮质激素。